运动能力提高到可以受意识控制的水平
A. 新生儿期
B. 乳儿期
C. 婴儿期
D. 幼儿期
E. 学龄期

正确答案：B。乳儿期

解析：本题考查不同年龄阶段心理卫生。乳儿期（B对）：指小儿1周岁以内的哺乳期。此期的特点是各种心身发育几乎是一生中最快的时期之一。神经系统的发育指数，呈直线上升；运动能力已提高到可以受意识控制的水平，较新生儿期进了一大步，他们已经学会了翻身、坐起、爬行、站立、行走、会双手及手眼协调玩玩具，会表达需要和情感。